小儿指纹紫黑，其主病是
A. 实寒证
B. 虚寒证
C. 虚热证
D. 血虚证
E. 血络郁闭

正确答案：E。血络郁闭

解析：“小儿指纹是指3岁小儿两手食指掌侧前缘的浅表脉络，正常小儿的指纹特点为在食指掌侧前缘，隐隐显露于掌指横纹附近，纹色浅红，呈单支且粗细适中，病理小儿指纹可概括为：‘三关测轻重，浮沉分表里，红紫辨寒热，淡滞定虚实’”，小儿指纹紫黑，为血络郁闭，病属重危，是因邪气亢盛，心肺气衰，脉络瘀阻所致（E对）。实寒证表现为指纹浓而增粗，颜色偏红（A错）。虚寒证表现为指纹浅淡而纤细，颜色偏红(B错)。虚热证表现为指纹浅淡而纤细，颜色偏紫（C错）。血虚证表现为指纹浅淡而纤细，颜色淡白（D错）。